肿疡毒势方盛，正气已虚，不能托毒外出者，内治方药宜选用
A. 透脓散
B. 仙方活命饮
C. 黄连解毒汤
D. 托里消毒散
E. 清肝解郁汤

正确答案：D。托里消毒散

解析：肿疡毒势方盛，正气已虚，不能托毒外出，当用补托法，补托法代表方剂为托里消毒散（D对）。透脓散为透托法代表方剂（A错），仙方活命饮、黄连解毒汤、清肝解郁汤为消法（BCE错）。